按照造成伤害的意图，可将伤害分为
A. 暴力与他杀
B. 自杀和自伤
C. 国际伤害外部原因分类和中国疾病分类
D. 国际疾病分类和中国疾病分类
E. 故意伤害和非故意伤害

正确答案：E。故意伤害和非故意伤害